可进行骨髓移植治疗的贫血是
A. 巨幼细胞性贫血
B. 再生障碍性贫血
C. 自身免疫性溶血性贫血
D. 慢性病贫血
E. 缺铁性贫血

正确答案：B。再生障碍性贫血

解析：可进行骨髓移植治疗的贫血是再生障碍性贫血（B对），再生障碍性贫血是骨髓造血功能衰竭引起的贫血，可进行骨髓移植重建健康的造血功能；巨幼细胞性贫血（P537）（A错）、缺铁性贫血（P537）（E错）是由于造血原料缺乏引起的贫血，可进行原发病及补充叶酸、VitB₁₂或补充铁剂等治疗；自身免疫性溶血性贫血（P557）（C错）由于免疫调节异常引起的贫血，可进行糖皮质激素、免疫抑制剂、脾切除等治疗；慢性病贫血（D错）是由于慢性炎症、感染、肿瘤等引起的贫血，可进行病因治疗、补充营养物质等治疗。